能贮存和促进精子成熟的器官是
A. 睾丸
B. 附睾
C. 尿道球腺
D. 尿道球
E. 睾丸纵隔

正确答案：B。附睾

解析：附睾（B对）能贮存精子并促进精子成熟。